有关硫酸阿托品散剂的叙述，错误的是
A. 硫酸阿托品可制成1：100倍散应用
B. 制备时可选用胭脂红等食用色素作着色剂
C. 配制时应采用等量递增法混合
D. 配制时应采用先制成低共熔物，再与其他固体粉末混匀
E. 分剂量应采用重量法

正确答案：D。配制时应采用先制成低共熔物，再与其他固体粉末混匀